牙周组织包括以下结构
A. 牙槽骨、牙周膜和牙龈
B. 牙质、牙釉质和牙龈
C. 牙粘合质、牙釉质和牙质
D. 牙周膜、牙粘合质和牙质
E. 牙槽骨、牙粘合质和牙周膜

正确答案：A。牙槽骨、牙周膜和牙龈

解析：牙周组织包括牙槽骨、牙周膜和牙龈(A对)三部分，牙质、牙釉质为牙组织。